女孩，2岁。身材矮小，语言、运动发育落后，平素纳差，便秘。查体：T36.2℃，P80次/分，神志清楚，反应淡漠，眼睑水肿，眼距宽，鼻梁低平，舌大而厚，皮肤粗糙，腹膨隆，未触及包块，四肢短小。心脏超声示心包积液。对诊断最有帮助的检查是
A. 立位腹部X线平片
B. 染色体核型分析
C. 血苯丙氨酸测定
D. 甲状腺功能检查
E. 骨龄片

正确答案：D。甲状腺功能检查

解析：2岁女性患儿，身材矮小，语言、运动发育落后（神经系统发育异常），平素纳差，便秘。查体：神志清楚，反应淡漠，眼脸水肿，眼距，鼻梁低平，舌大而厚，皮肤粗糙，腹膨隆，未触及包块，四肢短小（先天性甲状腺功能减退症典型表现）。心脏超声示心包积液。综合患儿临床症状和、体征及辅助检查，考虑诊断为先天性甲状腺功能减退症。对诊断最有帮助的检查是甲状腺功能检查（D对），立位腹部X线平片（A错）无法诊断。染色体核型分析（B错）用于诊断染色体异常引起的遗传病。血苯丙氨酸测定（C错）用于测定苯丙酮尿症。骨龄片（E错）用于确定骨龄。